可迅速控制痛风急性期症状的药物是
A. 碳酸氢钠
B. 非布司他
C. 别嘌醇
D. 秋水仙碱
E. 苯溴马隆

正确答案：D。秋水仙碱

解析：本题考查秋水仙碱。可迅速控制痛风急性期症状的药物是秋水仙碱（D对）。秋水仙碱是治疗急性痛风的首选药物，不宜长期应用。治疗痛风发作间歇期及慢性痛风和痛风性肾病期的药物有：苯溴马隆（E错）、丙磺舒、别嘌醇（C错）和非布索坦。碳酸氢钠（A错）常用于痛风治疗药丙磺舒服药时期的碱化尿液，以减少尿酸结晶和痛风结石及肾内尿酸沉积的危险。非布司他（B错）主要用于痛风缓解期控制尿酸的水平，适用于具有痛风症状的高尿酸血症的长期治疗。